患者男，56岁，在无明显诱因情况下，突然出现左眼闭眼不能，刷牙时口角漏水，笑时口角歪斜，患侧抬眉额纹消失，检查：舌前2/3味觉减退，泪腺分泌正常、听觉无异常。诊断
A. 膝状神经节与镫骨肌神经
B. 鼓索神经与镫骨肌神经
C. 膝状神经节与脑桥
D. 鼓索神经与腮腺之间
E. 茎乳孔与腮腺之间

正确答案：B。鼓索神经与镫骨肌神经

解析：本题考查面神经功能检查。在无明显诱因情况下，突然出现左眼闭眼不能，刷牙时口角漏水，笑时口角歪斜，患侧抬眉额纹消失，检查：舌前2/3味觉减退，泪腺分泌正常、听觉无异常。诊断为鼓索神经与镫骨肌神经（B对）。面瘫的症状还取决于损害的部位。若病变发生在茎乳孔外，一般都不发生味觉、泪液、唾液、听觉等方面的变化；病变部位更高，在鼓索与镫骨肌支之间，除完全性面瘫外，还可有味觉异常或丧失以及唾液腺分泌障碍；如病变累及支配镫骨肌的神经分支，可出现听觉过敏；病变累及膝状神经节，可出现耳廓及外耳道感觉迟钝或剧痛（A错）；如病变累及岩浅大神经，可出现泪腺分泌障碍；若病变在脑桥与膝状神经节（C错）之间，波及听神经，可有耳鸣、耳聋及眩晕；如同时出现感觉功能与副交感功能的障碍时，则所出现的症状对损害的发生部位具有定位意义（DE错）。